不适合粉末直接压片的辅料是
A. 微粉硅胶
B. 可压性淀粉
C. 微晶纤维素
D. 蔗糖
E. 乳糖

正确答案：D。蔗糖

解析：本题考查粉末直接压片法的药用辅料。粉末直接压片法的药用辅料包括各种型号的微晶纤维素、喷雾干燥乳糖、磷酸氢钙二水合物、可压性淀粉、微粉硅胶（优良的助流剂），不包括蔗糖（D错，为本题正确答案）。